医师隐匿、伪造或者擅自销毁医学文书且情节严重的，应给予的行政处罚是
A. 罚款
B. 责令改正
C. 通报批评
D. 吊销执业证书
E. 暂停执业活动

正确答案：D。吊销执业证书

解析：隐匿、伪造或者擅自销毁医学文书及有关资料，情节严重的，由县级以上人民政府卫生行政部门吊销其执业证书（D对）。题干中强调“情节严重”，说明应比暂停执业活动处罚严重（E错）。